下列哪个选项不能作为生物学标志
A. 接触生物学标志
B. 效应标志
C. 易感性标志
D. 服用剂量

正确答案：D。服用剂量

解析：本题考查生物学标志。生物标志是指能反映已被机体吸收的外源化学物或其生物学后果的各类测定指标，可分为暴露标志（A对）、效应标志（B对）和易感性标志（C对）。服用剂量（D错，为本题正确答案）不能作为生物学标志。